社会医学研究的主要人群是
A. 患者人群
B. 全体居民
C. 社区中的疾病群体
D. 潜在的患者人群
E. 传染病人群

正确答案：B。全体居民

解析：本题考查社会医学研究的主要人群。社会医学是从社会的角度研究与人群生老病死有关的医学问题，其主要研究人群是全体人群（B对ACDE错）。